属于糖皮质激素类药物的是
A. 茶碱
B. 沙美特罗
C. 噻托溴铵
D. 孟鲁司特
E. 布地奈德

正确答案：E。布地奈德

解析：本题考查平喘药的分类。布地奈德（E对）属于吸入性糖皮质激素，用于支气管哮喘的症状和体征的长期控制。除布地奈德外吸入性糖皮质激素还有丙酸倍氯米松、丙酸氟替卡松。茶碱（A错）为磷酸二酯酶抑制剂。沙美特罗（B错）为长效β₂受体激动剂。噻托溴铵（C错）为长效M胆碱受体阻断剂。孟鲁司特（D错）为白三烯受体阻断剂。